新生儿生理性黄疸，下列哪项是错误的
A. 生后2～3天出现黄疸
B. 一般情况良好
C. 足月儿14天内消退
D. 足月儿不超过204μmol/L（12mg/dl）
E. 结合胆红素超过25μmol/L

正确答案：E。结合胆红素超过25μmol/L